制备栓剂的油脂性基质为
A. 磷酸氢钙
B. 可可豆脂
C. 纤维素衍生物
D. 淀粉
E. 硬脂酸镁

正确答案：B。可可豆脂

解析：本题考查的是栓剂的油脂性基质。制备栓剂的油脂性基质为可可豆脂（B对）。栓剂的油脂性基质：（1）可可豆脂：常温下为黄白色固体，可塑性好，无刺激性，能与多种药物配伍使用。熔点为31℃～34℃，加热至25℃开始软化，在体温即能迅速融化，10℃～20℃时易粉碎成粉末。（2）半合成脂肪酸甘油酯类：本类基质不易酸败，贮藏中也比较稳定，为目前应用较多的油脂性栓剂基质，其中有半合成椰子油酯、半合成山苍子油酯、半合成棕榈油酯等。磷酸氢钙（A错）与淀粉（D错）可作为制备片剂的吸收剂。片剂的吸收剂：适用于原料药（含中间体）中含有较多挥发油、脂肪油或其他液体，而需制片者。常用的吸收剂有淀粉、硫酸钙二水物、磷酸氢钙等。淀粉还可作为制备片剂的崩解剂。纤维素衍生物（C错）可作为制备片剂的黏合剂。片剂的黏合剂：本身具有黏性，能增加药粉间的黏合作用，以利于制粒和压片的辅料。常用的黏合剂有淀粉浆（糊）、糖浆、胶浆类、微晶纤维素、纤维素衍生物等。硬脂酸镁（E错）可作为制备片剂的润滑剂。片剂的润湿剂：本身无黏性，但能润湿并诱发药粉黏性的液体。适用于具有一定黏性的药料制粒压片。常用的湿润剂有水、乙醇等。